α-受体阻断剂的禁忌症
A. 低钾血症
B. 痛风
C. 体位性低血压
D. 双侧肾动脉狭窄
E. 2-3度房室传导阻滞

正确答案：C。体位性低血压

解析：本题考查药物的禁忌症。α-受体阻断剂的禁忌症是体位性低血压（C对）。α受体阻断剂体位性低血压者禁用，心力衰竭者慎用。痛风（B错）为噻嗪类利尿剂禁忌症。双侧肾动脉狭窄（D错）是血管紧张素转换酶抑制剂（ACEI）的禁忌症。2-3度房室传导阻滞（E错）为非二氢吡啶类钙通道阻滞剂的禁忌症。